下列疾病中，纵隔向患侧移位的是
A. 急性脓胸
B. 慢性脓胸
C. 张力性气胸
D. 进行性血胸
E. 血气胸

正确答案：B。慢性脓胸

解析：慢性脓胸（B对）由于长期慢性炎症刺激，导致脏、壁层胸膜（即脓腔壁）纤维性增厚，壁胸膜增厚的纤维板使肋骨聚拢，肋间隙变窄，胸廓塌陷，脓腔壁收缩可使纵隔向患侧移位。急性脓胸（A错）和进行性血胸（D错）患者短期内均可出现患侧胸膜腔内液体增加，推移纵膈向健侧移位；张力性气胸（C错）和血气胸（E错）病人的患侧胸内压高于健侧，可压迫纵隔向健侧偏移。